有关皮瓣的特点和适应证下面说法错误的是
A. 皮瓣移植抗感染力强、愈合快
B. 皮瓣包括皮下脂肪层，可用于凹陷缺损畸形整复
C. 皮瓣不适合于移植在肌腱、关节面、骨面等暴露的创面上
D. 皮瓣移植后收缩性小
E. 皮瓣可对重要血管、脑膜等起保护作用

正确答案：C。皮瓣不适合于移植在肌腱、关节面、骨面等暴露的创面上

解析：本题考查皮瓣移植的特点及适应证。皮瓣适合于移植在肌腱、关节面、骨面等暴露的创面上（C错，为本题的正确答案）。皮瓣因含有供应其血运的蒂部，从而具有抗感染力强、愈合快（A对）的特点。皮瓣的适应证较为广泛，皮瓣因带有丰富的皮下脂肪脂肪组织，可用于凹陷缺损畸形整复（B对），对保护重要组织、脑膜等更为常用（E对）。皮瓣移植后，由于带有全层皮肤和丰富的脂肪组织，其收缩性远较游离植皮小得多（D对），而且可耐受外力摩擦。